药物制成靶向制剂的目的是
A. 减小药物的扩散速度和减小药物的溶出速率，用药后能在较长时间内持续释放药物以达到延长药效的目的
B. 使释药速度接近零级速度过程，药物能在预定时间内自动以预定速度释放，血药浓度长时间恒定维持在有效浓度范围内
C. 缩短药物的生物半衰期
D. 降低药物的作用强度
E. 增强药物对靶组织的特异性，提高药物疗效，降低药物的毒副作用

正确答案：E。增强药物对靶组织的特异性，提高药物疗效，降低药物的毒副作用

解析：本题考查靶向制剂的特点。药物制成靶向制剂的目的是增强药物对靶组织的特异性，提高药物疗效，降低药物的毒副作用（E对）。靶向制剂特点：靶向制剂系指药物与载体结合或被载体包裹能将药物直接定位于靶区，或给药后药物集结于靶区，使靶区药物浓度高于正常组织的给药体系。靶向制剂可使药物浓集于靶组织、靶器官、靶细胞及其周围，提高疗效并显著降低对其他组织、器官及全身的毒副作用。缓释制剂：系指在规定释放介质中，按要求缓慢地非恒速释放药物，其与相应的普通制剂比较，给药频率比普通制剂减少一半或给药频率比普通制剂有所减少，且能显著增加患者的顺应性的制剂。释药机理：减小药物的扩散速度和减小药物的溶出速率，用药后能在较长时间内持续释放药物以达到延长药效的目的（A错）。控释制剂：系指在规定释放介质中，按要求缓慢地恒速释放药物，其与相应的普通制剂比较，给药频率比普通制剂减少一半或有所减少，血药浓度比缓释制剂更加平稳，且能显著增加患者的顺应性的制剂。释药机理：使释药速度接近零级速度过程，药物能在预定时间内自动以预定速度释放，血药浓度长时间恒定维持在有效浓度范围内（B错）。生物半衰期（C错）：是指体内药量或药物浓度消除一半所需的时间，又称消除半衰期。生物半衰期是衡量药物从体内消除速度快慢的指标。剂型影响中药制剂的作用强度（D错）：同一药物的不同剂型给药后产生的药效作用强度和时间存在差异，如口服剂型中有效成分经过肝脏代谢，将有一部分损失；栓剂直肠给药，有效成分通过直肠下静脉吸收，可绕过肝脏直接进入体循环；静脉注射剂的药物则直接进入血液。这些不同剂型的生物利用度存在较大差异，制剂的作用强度明显不同。